部分激动药的特点是
A. 与受体亲和力高而无内在活性
B. 与受体亲和力高而有内在活性
C. 具有较强亲和力而内在活性不强，低剂量可产生激动效应，高剂量可拮抗激动药的作用
D. 具有一定亲和力，但内在活性弱，增加剂量后内在活性增强
E. 无亲和力，也无内在活性

正确答案：C。具有较强亲和力而内在活性不强，低剂量可产生激动效应，高剂量可拮抗激动药的作用